黄芪中含有的黄芪甲苷，其结构类型是
A. 醌类
B. 三萜类
C. 甾体类
D. 香豆素类
E. 黄酮类

正确答案：B。三萜类

解析：本题考查的是黄芪甲苷的结构类型。黄芪中含有的黄芪甲苷，其结构类型是三萜类（B对）。黄芪的化学成分众多，主要含皂苷类、黄酮类、多糖类及氨基酸类等。黄芪皂苷具有多种生物活性，其中黄芪甲苷是黄芪中主要生理活性成分。《中国药典》以黄芪甲苷和毛蕊异黄酮葡萄糖苷为指标成分进行药材和饮片的含量测定，要求药材含黄芪甲苷不得少于0.080%，饮片含黄芪甲苷不得少于0.060%；要求药材和饮片含毛蕊异黄酮葡萄糖苷不得少于0.020%。醌类（A错）在许多常用中药中，如大黄、虎杖、丹参、紫草等存在此类化合物，其中许多有明显的生物活性。甾体类（C错）：甾体类化合物是广泛存在于自然界中的一类天然化学成分，包括植物甾醇、胆汁酸、C₂₁甾类、昆虫变态激素、强心苷、甾体皂苷、甾体生物碱、蟾毒配基等。香豆素类（D错）：香豆素是邻羟基桂皮酸的内酯，广泛分布于高等植物中，尤其以芸香科和伞形科为多见，少数发现于动物和微生物中。在植物体内，它们往往以游离状态或与糖结合成苷的形式存在。黄酮类（E错）：黄酮类化合物广泛存在于自然界中，多存在于高等植物及羊齿类植物中。苔类中含有的黄酮类化合物为数不多，而藻类、霉菌、细菌中没有发现黄酮类化合物。含黄酮类化合物的中药有黄芩、葛根、银杏叶、槐花、陈皮、满山红等。